既能破气消积，又能化痰除痞的药物是
A. 木香
B. 丁香
C. 川椒
D. 香附
E. 枳实

正确答案：E。枳实

解析：本题考查的是枳实的功效。既能破气消积，又能化痰除痞的药物是枳实（E对）。枳实：【功效】破气消积，化痰除痞。木香（A错）：【功效】行气止痛，健脾消食。丁香（B错）：【功效】温中降逆，温肾助阳。川椒（C错）指花椒。花椒：【功效】温中止痛，杀虫止痒。香附（D错）：【功效】疏肝理气，调经止痛。